《医疗器械监督管理条例》规定，国家对医疗器械实行分类管理，第二类是指
A. 植入人体的医疗器械
B. 用于支持、维持生命的医疗器械
C. 通过常规管理足以保证其安全性、有效性的医疗器械
D. 对其安全性、有效性应当加以控制的医疗器械
E. 对其安全性、有效性必须严格控制的医疗器械

正确答案：E。对其安全性、有效性必须严格控制的医疗器械

解析：本题考查医疗器械的分类。《医疗器械监督管理条例》规定，国家对医疗器械实行分类管理，第二类是指对其安全性、有效性必须严格控制的医疗器械（E对）。医疗器械的分类：国家对医疗器械按照风险程度实行分类管理。评价医疗器械风险程度，应当考虑医疗器械的预期目的、结构特征、使用方法等因素。第一类是风险程度低，实行常规管理可以保证其安全、有效的医疗器械（C错）。如外科用手术器械（刀、剪、钳、镊夹、针、钩）、听诊器（无电能）、反光镜、反光灯、医用放大镜、（中医用）刮痧板、橡皮膏、透气胶带、手术衣、手术帽、检查手套、集液袋等。第二类是具有中度风险，需要严格控制管理以保证其安全、有效的医疗器械。如血压计、体温计、心电图机、脑电图机、手术显微镜、（中医用）针灸针、助听器、皮肤缝合钉、避孕套、避孕帽、无菌医用手套、睡眠监护系统软件、超声三维系统软件、脉象仪软件等。第三类是具有较高风险，需要采取特别措施严格控制管理以保证其安全、有效的医疗器械。如心脏起搏器、体外反搏装置、血管内窥镜、超声肿瘤聚焦刀、高频电刀、微波手术刀、医用磁共振成像设备、钴60治疗机、正电子发射断层扫描装置（PECT）、植入器材、植入式人工器官、血管支架、血管内导管、一次性使用输液器、输血器等。